肺痨咳嗽，咳嗽不甚时应采取的是
A. 治标
B. 治本
C. 标本兼治
D. 先治本后治标
E. 反治

正确答案：B。治本

解析：本题主要考察治疗疾病的基本原则。缓则治本，指病势缓和，病情缓慢，先治其本，本病愈而标病自除多用于慢性疾病，病情缓和、病势迁延、暂无急重病状；或病势向愈，正气已虚，邪尚未尽之际。而肺痨之咳嗽，肺肾阴虚是本，咳嗽是标，标病不至于危及生命，故治疗多不选用单纯止咳之剂来治标，而采用补肺肾之阴以治其本，本病得以恢复，咳嗽等诸症也自然会消除（B对）。反治，指顺从病证的外在假象而治的治则（E错）。急则治标，指标病危急，先治其标，标病缓解再治本病，一般适用于：一是卒病且病情非常严重，治暴病不宜缓，初病邪未深入，当急治以去其邪，邪去则正气不伤，患者易于恢复；二是在疾病过程中，出现危及生命的某些症状时，如大出血病变，出血为标，出血之因为本，但其势危急，故必以止血治标为首务，待血止后再治出血之因以图本；三是疾病过程中出现某些急重症状，或症状不除，无法进行治疗时，则当权而先治其标；四是某些慢性病患者，原由宿疾复感邪气，当旧病缓和，新病较急时，每应先治其标，待新病愈后，再治宿疾而治本（A错）。标本兼治，指标病与本病并重，应治标与治本兼顾，是在标病与本病俱急，或标病与本病俱缓之时采取的一种治则（C错）。